下述各肌中，何者对髋关节既有屈又有旋外作用
A. 臀大肌
B. 臀中肌
C. 股直肌
D. 股二头肌
E. 髂腰肌

正确答案：E。髂腰肌

解析：臀大肌（A错）使髋关节伸和旋外；臀中肌（B错）使髋关节外展、旋内和旋外；股直肌（C错）属于股四头肌，作用是屈髋关节和伸膝关节；股二头肌（D错）屈膝、伸髋，使已屈的膝关节旋外；髂腰肌（E对）对髋关节既有屈又有旋外作用，下肢固定时，可使躯干前屈。